卫生防疫单位开展的传染病漏报调查属于
A. 主动监测
B. 被动监测
C. 哨点监测
D. 以实验室为基础的监测
E. 以医院为基础的监测

正确答案：A。主动监测

解析：本题考查主动监测。主动监测是指根据疾病防控等公共卫生问题的特殊需要，由上级单位专门组织调查收集资料。我国的免疫接种率监测、为修正传染病报告监测数据所开展的传染病漏报调查，以及对某些重点疾病（如不明原因发热）或某些行为因素（如吸烟、吸毒）的监测活动，多属于主动监测（A对BCDE错）范畴。